下列代谢性酸中毒合并呼吸性碱中毒的特点中，哪项是不正确的？
A. HCO₃⁻减少和PaCO₂浓度均降低，且均小于代偿的最低值
B. SB、AB、BB均降低，AB<SB
C. BE负值增大
D. AG减小
E. pH变化不大

正确答案：D。AG减小

解析：代谢性酸中毒合并呼吸性碱中毒是酸碱混合型的酸碱平衡紊乱，所以pH变化不大（E对），该型特点为PaCO₂和血浆HCO₃⁻浓度均降低，且均小于代偿的最低值（A对）。由于血浆HCO₃⁻浓度均降低，所以SB、AB、BB均降低，AB<SB（B对），BE负值增大（C对）。AG减小（D错，为本题正确答案）在诊断酸碱失衡方面意义不大，仅见于未测定阴离子减少或未测定阳离子增多，当发生代谢性酸中毒，AG可能增大，也可能不变。